致畸作用的敏感期是
A. 着床期
B. 器官发生期
C. 胎儿期
D. 新生儿期
E. 胚泡形成期

正确答案：B。器官发生期